胆总管与胰管共同开口在
A. 十二指肠上部
B. 十二指肠降部
C. 十二指肠纵襞上端
D. 十二指肠大乳头
E. 十二指肠纵襞中部

正确答案：D。十二指肠大乳头

解析：胆总管与胰管汇合形成肝胰壶腹，开口于十二指肠大乳头(D对)。